治疗紫癜，血热妄行之首选方剂是
A. 四生汤
B. 十灰散
C. 清营汤
D. 犀角地黄汤
E. 华斑汤

正确答案：D。犀角地黄汤

解析：本证以起病急骤，皮肤紫癫密集，色红，心烦口渴，便秘尿赤为临床特征。因风热邪毒入里化热，或内热化火，内舍血分，迫血妄行，溢于脉外，出现皮肤黏膜紫癫，所以宜用具有清热解毒，凉血止血功效的犀角地黄汤（D对）；四生汤具有燥湿化痰，消痞散结的功效，用于治疗风湿性关节炎等，四神汤具有健脾祛湿，利尿消肿的功效，用于治疗脾湿不运证等（A错）；十灰散具有凉血止血之功效，主治血热妄行之上部出血证，症见呕血、吐血、咯血、嗽血、衄血等，血色鲜红，来势急暴，舌红，脉数（B错）；清营汤具有清营解毒，透热养阴之功效，主治热入营分证，症见身热夜甚，神烦少寐，时有谵语，目常喜开或喜闭，口渴或不渴，斑疹隐隐，脉细数，舌绛而干（C错）；化斑汤具有清热凉血，解毒化斑的功效，主治温病发斑，高热口渴，神昏谵语。太阴温病，不可发汗，发汗而汗不出，反发斑疹者（E错）。